慢性肉芽肿病
A. HIV感染
B. C1-INH缺乏
C. 先天性胸腺发育不全
D. Bruton酪氨酸激酶基因缺陷
E. 还原型辅酶Ⅱ氧化酶系统基因缺陷

正确答案：E。还原型辅酶Ⅱ氧化酶系统基因缺陷

解析：还原型辅酶Ⅱ氧化酶系统基因缺陷者可患慢性肉芽肿病。掌握“免疫缺陷概述及原发性、获得性免疫缺陷病”知识点。